拔除上颌第一磨牙时，牙根完整拔除，但上颌窦有直径约8mm穿孔，患者的最佳处理方法是
A. 立即行上颌窦瘘修补术
B. 拔牙后常规处理，待其自然愈合
C. 牙槽窝填塞碘仿纱条
D. 拔牙后常规处理，将两侧牙龈拉拢后缝合
E. 按干槽症治疗方法处理

正确答案：A。立即行上颌窦瘘修补术

解析：已有交通时，如小的穿孔（直径2mm左右），可按拔牙后常规处理，待其自然愈合。中等大小的穿孔（直径2～6mm）也可按上述方法处理后，将两侧牙龈拉拢后缝合。交通口大于7mm，需用邻位组织瓣关闭创口。掌握“牙槽外科”知识点。